麻醉上牙槽中神经应选择
A. 上颌结节注射法
B. 眶下孔注射法
C. 腭大孔麻醉
D. 腭前孔注射法
E. 翼下颌注射法

正确答案：B。眶下孔注射法

解析：本题考查阻滞麻醉。麻醉上牙槽中神经应选择眶下孔注射法（B对）。1.眶下神经阻滞麻醉：将局麻药注入眶下孔或眶下管，以麻醉眶下神经及其分支，又称眶下孔或眶下管注射法。可麻醉上牙槽前、中神经支配区域。2.上牙槽后神经阻滞麻醉：注射局麻药液于上颌结节（A错），以麻醉上牙槽后神经，又称上颌结节注射法。3.腭前神经阻滞麻醉：将局麻药注射入腭大孔或其附近以麻醉腭前神经，故又称腭大孔注射法（C错）。4.鼻腭神经阻滞麻醉：将局麻药注入腭前孔（切牙孔）以麻醉鼻腭神经，又称腭前孔注射法（D错）。5.下牙槽神经阻滞麻醉：是将局麻药注射到翼下颌间隙内下颌小舌平面以上的下颌神经沟附近，局麻药扩散后可麻醉下牙槽神经，故亦称翼下颌注射法（E错）。